Garré骨髓炎的好发部位是
A. 上颌后区
B. 下颌后区
C. 上颌前区
D. 下颌前区
E. 下颌角处

正确答案：B。下颌后区

解析：好发于青少年，下颌骨比上颌骨多见，特别是下颌后区。掌握“Garré骨髓炎及致密性骨炎”知识点。